在药品质量标准中，属于药物安全性检查的项目是
A. 溶出度
B. 热原
C. 重量差异
D. 含量均匀度
E. 干燥失重

正确答案：B。热原

解析：本题考查药品标准检查项下的内容。在药品质量标准中，属于药物安全性检查的项目是热原（B对）。热原属于药品安全性检查的项目，其他药品安全性检查的项目还有“异常毒性”、“无菌”、“细菌内毒素”、“升压物质”、“降压物质”及“过敏反应”等。均一性检查主要是检查制剂的均匀度，如片剂等固体制剂的“重量差异”（C错）、“含量均匀度检查法”（D错）。有效性检查的项目通常为和药物的疗效有关、但不能通过其分析有效控制的项目，如片剂通常需要检查“崩解时限”或测定“溶出度”（A错）等。药物的纯度检查即为药物中的杂质检查，多为限量检查，杂质检查分为一般杂质检查和特殊杂质检查，一般杂质是指在自然界中分布广泛、在多种药品的生产中可能引入的杂质，如氯化物、砷盐，及本标准中的易炭化物、干燥失重（E错）、炽灼残渣、重金属等，特殊杂质为某种药物中特定的杂质，如阿司匹林中游离水杨酸的检查。